某男，30岁，原患痔疮。近期过食辛辣复发，大便下血鲜红、肛门灼热，舌红。证属血热妄行，宜选用的药是
A. 白及
B. 棕榈炭
C. 小蓟
D. 地榆
E. 艾叶

正确答案：D。地榆

解析：本题考查的是地榆的主治病证。原患痔疮。近期过食辛辣复发，大便下血鲜红、肛门灼热，舌红。证属血热妄行，宜选用的药是地榆（D对）。地榆：【性能特点】本品苦降泄，酸收敛，微寒清，入肝、胃、大肠经。解热毒、凉血止血、消肿止痛，血热出血者宜用；又因沉降入下焦，善治下焦血热妄行诸证，为治痔疮、便血及崩漏之佳品。外用善解毒消肿、敛疮止痛，为治水火烫伤之要药。【主治病证】（1）血热之咳血、衄血、吐血、尿血、便血、痔血、崩漏及月经过多。（2）烫伤，湿疹，皮肤溃烂，疮疡肿毒。白及（A错）：【性能特点】本品涩黏能敛，苦寒清泄，甘而缓补。入肺、肝、胃经。善收敛止血，兼益肺胃，治体内外出血，最宜肺胃损伤之咳血、吐血，以及肺痈咳吐脓血。善消肿生肌，治痈疽疮疡，初起未脓服之可消，溃久不敛敷之可愈；外用冶烫伤、皮肤皲裂、肛裂。【主治病证】（1）咳血，衄血，吐血，外伤出血。（2）疮痈肿毒，烫伤，手足皲裂，肛裂。（3）肺痈而咳吐腥痰脓血日渐减少者。棕榈炭（B错）：【性能特点】本品涩敛苦平，入肺、肝与大肠经。专收敛止血，凡出血无论寒热虚实皆宜，治出血无瘀者最佳。【主治病证】崩漏，便血，吐血，咳血，尿血。小蓟（C错）：【性能特点】本品苦凉清泄，甘淡渗利，入心、肝经。既凉血止血、解热毒，又兼散瘀止血、利尿导热从小便而出，善治血热出血、热毒疮肿，尿血、血淋用之尤佳。【主治病证】（1）血热之尿血、血淋、咳血、衄血、吐血、崩漏，外伤出血。（2）热毒痈肿。艾叶（E错）：【性能特点】本品辛香苦燥温散，生温熟热，炒炭兼敛，入肝、脾、肾经。内服炒炭温经散寒、暖宫、收敛而止血崩；生用温经散寒湿、暖宫理气血而止痛、止血、止带。外用煎汤熏洗，燥湿杀虫而止痒；温灸能温通经脉、散寒而止痛或消肿。作用偏于中下二焦，既为治妇科崩漏与带下之要药，又为灸科温灸之主药。【主治病证】（1）虚寒性崩漏下血、胎漏。（2）经寒痛经、月经不调，带下清稀，宫冷不孕。（3）脘腹冷痛。（4）湿疹瘙痒（外用）。此外，可用于温灸。